米非司酮的药理作用是
A. 阻断孕激素受体
B. 激动雌激素受体
C. 促进受精卵着床
D. 抑制黄体生成素释放
E. 促进垂体后叶素释放

正确答案：A。阻断孕激素受体

解析：本题考查米非司酮的药理作用。米非司酮是炔诺酮的衍生物，具有阻断孕激素受体的药理作用（A对）。